加工过程中，使玄参内部变成乌黑色的成分属于
A. 环烯醚萜苷类
B. 生物碱类
C. 黄酮类
D. 蒽醌类
E. 香豆素类

正确答案：A。环烯醚萜苷类